验证杂质限量检查方法需考察的指标有
A. 准确度
B. 专属性
C. 检测限
D. 定量限
E. 线性

正确答案：B、C。专属性；检测限